男，52岁。皮肤、巩膜黄染2个月。大便颜色变浅，无腹痛及发热。查体：皮肤、巩膜黄染，右上腹触及囊性包块，无压痛。腹部B超示：胆总管扩张，胆囊大，胰腺显示不清。该患者最可能的诊断是
A. 胆总管结石
B. 胆囊癌
C. 慢性胆囊炎
D. 慢性胰腺炎
E. 壶腹周围癌

正确答案：E。壶腹周围癌

解析：中年男性患者，皮肤巩膜黄染，大便颜色变浅（提示梗阻性黄疸）。查体：右上腹触及囊性包块（提示胆囊肿大），无压痛（梗阻性黄疸伴无痛性胆囊肿大，Courvoisier征阳性）。腹部B超示：胆总管扩张，胆囊大（提示胆道下段梗阻）。综合该患者的病史、体查及实验室检查，最可能的诊断是壶腹周围癌（E对）。胆总管结石（七版黄家驷外科学P1797）（A错）的主要临床症状是胆管梗阻和胆管炎，典型症状是在开始时出现胆绞痛，常有恶心及呕吐，在有胆道感染的病人随后可出现寒战、发热、出汗，24小时之后临床上出现黄疸。胆囊癌（P452）（B错）早期无特异性表现，晚期可触及肿大的胆囊，有实性感，一般不出现黄疸。慢性胆囊炎（P445）（C错）多表现为高脂饮食后出现右上腹痛，可伴有恶心、呕吐，较少出现黄疸，腹部体查可无体征或仅有右上腹轻度压痛，超声可见胆囊壁增厚，胆囊排空障碍或胆囊内结石。慢性胰腺炎（P461）（D错）的典型临床表现为腹痛、体重下降、糖尿病及脂肪泻。